《中国药典》规定，黄芪含量测定指标成分之一是
A. 阿魏酸
B. 毛蕊异黄酮葡萄糖苷
C. 芦丁
D. 东莨菪内酯
E. 异嗪皮啶

正确答案：B。毛蕊异黄酮葡萄糖苷

解析：本题考查黄芪中的主要成分。《中国药典》以黄芪甲苷和毛蕊异黄酮葡萄糖苷（B对）为指标成分对黄芪进行药材和饮片的含量测定，要求药材含黄芪甲苷不得少于0.080%，饮片含黄芪甲苷不得少于0.060%；要求药材和饮片含毛蕊异黄酮葡萄糖苷不得少于0.020%。《中国药典》以阿魏酸（A错）和挥发油为指标成分对当归进行含量测定，要求阿魏酸含量不得少于0.050%，挥发油含量不得少于0.4%（ml/g）。《中国药典》以总黄酮和芦丁（C错）为指标成分对槐米或槐花进行含量测定。要求槐花总黄酮（以芦丁计）不少于8.0%，槐米总黄酮不少于20.0%，对照品采用芦丁；要求芦丁含量，槐花不得少于6.0%，槐米不得少于15.0%。《中国药典》以东莨菪碱（D错）为指标成分对洋金花进行含量测定，要求东莨菪碱不得少于0.15%。《中国药典》采用高效液相色谱法测定肿节风药材中异嗪皮啶（E错）和迷迭香酸含量，其中异嗪皮啶含量不得少于0.020%，迷迭香酸含量不得少于0.020%。